二陈汤主治之咳嗽属于
A. 湿痰
B. 寒痰
C. 热痰
D. 风痰
E. 燥痰

正确答案：A。湿痰

解析：湿痰咳嗽多由脾失健运，湿无以化，湿聚成痰，郁积而成。湿痰为病，犯肺致肺失宣降，导致咳嗽痰多，用二陈汤（A对）。寒痰用苓甘五味姜辛汤（B错）。热痰用清气化痰丸。因痰郁气滞，气郁化火，痰热互结所致，为治疗热痰咳嗽的常用方（C错）。风痰用半夏白术天麻汤（D错）。燥痰用贝母瓜蒌散。为治疗燥痰证的常用方（E错）。